女性，32岁。胃溃疡病史3年，今突发上腹剧痛，面色苍白，大汗。查体：全腹压痛，腹肌紧张，似穿孔。急性穿孔诊断后几小时内手术治疗效果最好
A. 48小时
B. 12小时
C. 24小时
D. 8小时
E. 10小时

正确答案：D。8小时

解析：青年女性患者，有胃溃疡病史，今突发上腹剧痛，查体见全腹压痛、腹肌紧张（腹膜刺激症状），结合患者病史和体查，应考虑为急性胃溃疡穿孔。溃疡穿孔后酸性的胃内容物流入腹腔，可引起化学性腹膜炎，约6～8小时后细菌开始繁殖，逐渐形成化脓性腹膜炎，因此穿孔后8小时内手术治疗效果最好（D对）。